用于心绞痛和心肌梗死的β受体阻滞药是
A. 普萘洛尔
B. 哌唑嗪
C. 酚妥拉明
D. 肾上腺素
E. 利血平

正确答案：A。普萘洛尔

解析：普萘洛尔有较强的β受体阻断作用，对β₁和β₂受体的选择性低，无内在拟交感活性。用药后心率减慢、心肌收缩力减弱和心输出量降低、冠脉血流量下降、心肌耗氧量明显减少。用于心律失常、心绞痛、高血压、甲状腺功能亢进的辅助治疗等（A对）。